1775年英国外科医生Pott报道扫烟囱工人所患的肿瘤是
A. 阴囊癌
B. 肺癌
C. 皮肤癌
D. 鼻窦癌
E. 膀胱癌

正确答案：A。阴囊癌